吴茱萸具有的功效是
A. 疏肝下气
B. 回阳救逆
C. 两者均是
D. 两者均不是

正确答案：A。疏肝下气

解析：本题考查的是吴茱萸的功效。吴茱萸具有的功效是疏肝下气（A对）。吴茱萸：【功效】散寒止痛，疏肝下气，燥湿止泻。附子：【功效】回阳救逆（B错），补火助阳，散寒止痛。